描述药物体内速度过程的动力学参数是
A. 表观分布容积
B. 零级速度过程
C. 清除率
D. 速率常数
E. 隔室模型

正确答案：D。速率常数